男性，55岁。右上后牙进食时咬合痛1个月，无自发痛史。检查：17牙冠完整，（牙合）面中度磨耗，近中边缘嵴处可见隐裂纹，不松动，叩痛（-），咬棉卷不适，牙髓活力正常，X线片未见异常。余留牙未见异常。该患者最佳治疗方案是
A. 调（牙合），随诊观察
B. 塑料全冠暂时修复
C. 铸造金属全冠修复
D. 金属烤瓷全冠修复
E. 牙髓治疗后全冠修复

正确答案：C。铸造金属全冠修复

解析：17为隐裂牙，且有咬合痛症状，其预后可能发展成牙髓炎、根尖周炎，还可能出现牙齿劈裂。该病例符合全冠修复的适应证，应进行全冠修复。患牙牙髓活力正常，不需要先做牙髓治疗，采用铸造金属全冠不会影响美观，而且可减少牙体预备量，避免活髓牙修复后牙本质敏感。正确答案选C。掌握“铸造金属全冠”知识点。